高温堆肥的卫生标准中规定蛔虫卵死亡率为
A. 65%～75%
B. 75%～85%
C. 85%～95%
D. 95%～100%
E. 80%～95%

正确答案：D。95%～100%

解析：本题考查高温堆肥的卫生标准中规定的蛔虫卵死亡率。高温堆肥的卫生标准中规定蛔虫卵死亡率为95%～100%（D对ABCE错）。